培养正气，提高抗病能力的方法有
A. 精神调养
B. 早期诊治
C. 锻炼身体
D. 控制传变
E. 人工免疫

正确答案：A、C、E。精神调养；锻炼身体；人工免疫

解析：本题考查的是培养正气，提高抗病能力的方法。培养正气，提高抗病能力的方法有精神调养（A对）、锻炼身体（C对）与人工免疫（E对）。未病先防的原则和方法：未病先防，即是在疾病发生之前，做好各种预防工作，以防止疾病的发生。疾病的发生，关系到邪正两个方面的因素。邪气是导致疾病发生的重要条件，而正气不足是疾病发生的内在原因，外邪通过内因而起作用。因此，未病先防，包括以下两个方面的原则和方法。1.扶助正气，提高抗病能力：增强体质，是提高正气抗邪能力的关键。调摄精神，修身养性；顺应自然，起居有常；劳逸适度，积精全神；锻炼身体，增强体质；饮食有节，顾护脾胃；针灸保健等措施，是增强体质、提高正气抗邪能力的主要方法。（1）重视精神调养。（2）加强身体锻炼。（3）注意生活起居。（4）人工免疫。2.消灭病邪，防止邪气侵害：邪气是导致疾病发生的重要条件，注意避免病邪的侵害，即要谨慎躲避外邪的侵害。（1）药物杀灭。（2）讲究卫生。（3）避免病邪侵害。（4）防范各种外伤。早期诊治（B错）与控制传变（D错）为既病防变是基本措施。既病防变是基本措施：1.早期诊治。2.控制疾病的传变。